心尖部触及舒张期震颤，提示
A. 二尖瓣关闭不全
B. 二尖瓣狭窄
C. 室间隔缺损
D. 动脉导管未闭
E. 主动脉瓣关闭不全

正确答案：B。二尖瓣狭窄